关于肝硬化腹水形成的因素，不正确的是
A. 门静脉压力增高
B. 原发性醛固酮增多
C. 低白蛋白血症
D. 肝淋巴液生成过多
E. 抗利尿激素分泌过多

正确答案：B。原发性醛固酮增多

解析：肝硬化腹水形成的因素有：①门静脉压力增高（A对），腹腔内脏血管床静水压增高，组织液回吸收减少而漏入腹腔；②有效循环血容量不足；③低白蛋白血症（C对），血浆胶体渗透压降低，毛细血管内液体漏人腹腔或组织间隙；④肝脏对醛固酮和抗利尿激素灭能作用减弱，导致继发性醛固酮增多（B错，为本题正确答案）和抗利尿激素过多（E对），使水钠重吸收增加；⑤肝淋巴液生成过多（D对），超过了淋巴循环引流的能力，肝窦内压力升高，自肝包膜表面漏人腹腔，参与腹水形成。